男，45岁。间断咳嗽2年，每年均于秋季出现，干咳为主，夜间明显，伴憋气，常常影响睡眠，白天症状常不明显。使用多种药物抗感染治疗无效，持续1～2个月后症状可自行消失。本次入秋后再次出现上述症状。体格检查未见明显异常。胸部X线片未见明显异常。通气功能正常。为明确诊断，宜采取的进一步检查措施是
A. 支气管镜
B. 睡眠呼吸监测
C. 胸部CT
D. 支气管激发试验
E. 血气分析

正确答案：D。支气管激发试验

解析：患者季节性咳嗽夜间明显，伴憋气，使用多种药物抗感染治疗无效，症状可自行缓解，均是哮喘的重要特征。体格检查未见明显异常，间断咳嗽，提示不典型哮喘，为明确诊断，应行支气管激发试验（D对）（支气管激发试验可以测定气道存在高反应性以明确诊断，适用于非哮喘发作期、FEV₁在正常预计值70%以上患者的检查）。支气管镜（A错）可用于中央型肺癌的诊断。胸部CT（C错）用于胸部肿瘤等占位性病变的诊断，不能了解肺功能的变化情况。睡眠呼吸监测（B错）用于夜间呼吸紊乱患者的检测措施，可作为继发性高血压的辅助检测。血气分析（E错）用于判断机体是否存在酸碱平衡失调以及缺氧和缺氧程度等。